治疗喘证风寒壅肺证，应首选的方剂是
A. 射干麻黄汤
B. 麻黄汤合华盖散
C. 二陈汤合三子养亲汤
D. 三拗汤合止嗽散
E. 生脉散合补肺汤

正确答案：B。麻黄汤合华盖散

解析：风寒壅肺证之实喘是由风寒上受，内舍于肺，邪实气壅，肺气不宣所致，治宜宣肺散寒，方用麻黄汤合华盖散（B对）。二陈汤合三子养亲汤为痰浊阻肺证之实喘的代表方（C错）。射干麻黄汤为冷哮代表方（A错）。三拗汤合止嗽散为风寒袭肺证之外感咳嗽代表方（D错）。生脉散合补肺汤为肺气虚耗证之虚喘的代表方（E错）。